性平，可治疗经闭，腰膝酸痛，淋证的药物是
A. 牛膝
B. 桃仁
C. 川芎
D. 益母草
E. 鸡血藤

正确答案：A。牛膝

解析：牛膝的功效为逐瘀通经，补肝肾，强筋骨，利尿通淋，引血下行（A对）。桃仁、川芎不能治疗淋证也不能治腰膝酸痛（BCD错）；益母草可治疗闭经和淋证，但不能治疗腰膝酸痛；鸡血藤（活血补血，调经止痛，舒筋活络）能治经闭，可活血补血养荣治疗腰膝疼痛，但此疼痛并非酸痛，鸡血藤也无治疗淋证之功（E错）。